下列有关桥体应具备的条件，说法正确的是
A. 与语言发音无关
B. 降低机械强度
C. 增加（牙合）力
D. 能够恢复缺牙的形态
E. 化学性能不稳定

正确答案：D。能够恢复缺牙的形态

解析：恢复缺失牙功能：桥体应能够恢复缺牙的形态和功能。如恢复缺失前牙的切割功能和语言发音清晰度；恢复后牙捣碎食物，引导咀嚼时的侧方运动的方向等功能。掌握“固定桥的设计”知识点。